镇痛强度为吗啡的1/10，代替吗啡使用的药物是
A. 哌替啶
B. 喷他佐辛
C. 美沙酮
D. 纳洛酮
E. 吲哚美辛

正确答案：A。哌替啶

解析：哌替啶的镇痛强度是吗啡的1/10，但成瘾性比吗啡轻，产生也较慢，可替代吗啡使用（A对）。